患者，男，50岁，1周来，喜食冷饮，消谷善饥，烦渴多饮，舌质红，舌苔黄，脉数。用药宜首选
A. 栀子
B. 黄芩
C. 黄连
D. 黄柏
E. 龙胆草

正确答案：C。黄连

解析：患者消谷善饥，烦渴多饮为胃火炽盛；黄连苦寒，入脾胃经，能清胃火；治疗首选黄连（C对）。栀子（A错）的功效是泻火除烦，清热利湿，凉血解毒，外用消肿止痛，焦栀子凉血止血。黄芩（B错）的功效是清热燥湿，泻火解毒，止血，安胎。善于清泻肺火及上焦实热。黄柏（D错）的功效是清热燥湿，泻火除蒸，解毒疗疮。善于清泄下焦湿热。龙胆草（E错）的功效是清热燥湿，泻肝胆火。